关于分娩的概念正确的是
A. 妊娠满37周至不满42足周分娩为足月产
B. 妊娠43周之后分娩为过期产
C. 妊娠满28周至不满31周分娩为早产
D. 妊娠28周及28周以内分娩为流产
E. 以上均不正确

正确答案：A。妊娠满37周至不满42足周分娩为足月产

解析：妊娠满37周至不满42足周分娩为足月产（A对），妊娠满42周及以上分娩为过期产（B错），妊娠满28周至不满37足周分娩为早产（C错），妊娠不足28周、胎儿体重不足1000g而终止者为流产（D错）。